有关直肠静脉丛的描述，错误的是
A. 直肠丛分为直肠粘膜下组织中的直肠内丛和位于肌层外面的直肠外丛两种
B. 直肠丛汇集成直肠上静脉、直肠下静脉和肛静脉
C. 直肠上静脉汇入肠系膜上静脉
D. 直肠下静脉汇入髂内静脉
E. 肛静脉汇入阴部内静脉

正确答案：C。直肠上静脉汇入肠系膜上静脉

解析：直肠丛汇集成直肠上静脉、直肠下静脉和肛静脉（B对）。直肠上静脉汇入肠系膜下静脉（C错，为本题正确答案）。直肠下静脉汇入髂内静脉（D对）。